感染性腹泻患者应用小檗碱+鞣酸蛋白属于
A. 超剂量用药
B. 非适应证用药
C. 有目的联合用药
D. 超适应证用药
E. 过度治疗用药

正确答案：E。过度治疗用药